有关脑膜炎球菌的描述，正确的是
A. 革兰染色阳性，体外抵抗力很弱，能产生自溶酶
B. 特异性荚膜多糖抗原与其致病作用无关
C. 能产生毒力较强的外毒素
D. 目前我国流行株以C群为主
E. 与淋球菌一样也属奈瑟菌属

正确答案：E。与淋球菌一样也属奈瑟菌属

解析：脑膜炎奈瑟菌（又称脑膜炎球菌）属奈瑟菌属（E对），革兰染色阴性（A错），呈肾形双球菌，0.6～0.8μm大小。有荚膜，无芽胞，不活动。为专性需氧菌，在普通培养基上不易生长，在巧克力或血培养基或卵黄培养基上生长良好。